金钱草的性状鉴别特征有
A. 茎表面浅棕色，密被黄色伸展的短柔毛
B. 茎表面棕色或暗棕红色，无毛或几无毛
C. 单叶对生，两面无毛或几无毛
D. 羽状复叶互生，小叶1-3片，下表面具灰白色紧贴的绒毛
E. 叶片水浸后对光透视，可见黑色或褐色条纹

正确答案：B、C、E。茎表面棕色或暗棕红色，无毛或几无毛；单叶对生，两面无毛或几无毛；叶片水浸后对光透视，可见黑色或褐色条纹

解析：本题考查的是金钱草的性状鉴别。金钱草的性状鉴别特征有茎表面棕色或暗棕红色，无毛或几无毛（B对）、单叶对生，两面无毛或几无毛（C对）、叶片水浸后对光透视，可见黑色或褐色条纹（E对）。金钱草【性状鉴别】药材常缠结成团，无毛或被疏柔毛。茎扭曲，表面棕色或暗棕红色，有纵纹，下部茎节上有时具须根，断面实心。叶对生，多皱缩，展平后呈宽卵形或心形，长1～4cm，宽1～5cm，基部微凹，全缘；上表面灰绿色或棕褐色，下表面色较浅，主脉明显突起，用水浸后，对光透视可见黑色或褐色条纹；叶柄长1～4cm。有的带花，花黄色，单生叶腋，具长梗。蒴果球形。气微，味淡。